男，38岁。支气管哮喘，用“沙美特罗氟替卡松”每日3次，效果仍不佳。则应采取的措施是
A. 加大药物用量
B. 加用茶碱类药物
C. 加用白三烯调节剂口服
D. 色甘酸钠
E. 加用酮替芬

正确答案：C。加用白三烯调节剂口服

解析：患者为中年男性，患有支气管哮喘，使用沙美特罗（长效β受体激动剂）和氟替卡松（吸入型糖皮质激素），属于慢性哮喘长期治疗方案中的第三级，效果不佳，首先选择采用白三烯调节剂（C对），可以减少吸入性糖皮质激素的用量并改善肺功能，减少哮喘的恶化。加大药物用量（A错）可能由于糖皮质激素用量的上升导致潜在的全身不良发应，如皮肤瘀斑，肾上腺功能受抑制及骨质疏松等症状，不作为最佳治疗措施。茶碱类药物（B错）与β₂受体激动剂联合应用时易导致心率增快和心律失常（十四版实用内科学P1706），故不做首选治疗措施。色甘酸钠（D错）可抑制IgE介导的肥大细胞释放的介质，属于控制性药物，常用于预防发作，但不作为哮喘长期治疗三级方案需增加使用的药物，故不作为首选治疗方案。酮替芬（E错）可抑制转和慢反应物质的释放，也属于控制性药物，哮喘中作用较弱（十四版实用内科学P1707），也不是哮喘长期治疗的三级方案中需增加使用的药物，故不作首选治疗方案。